成熟mRNA的前体是
A. rRNA
B. tRNA
C. hnRNA
D. 核内小RNA
E. 核仁小RNA

正确答案：C。hnRNA

解析：成熟mRNA的前体是hnRNA（不均一核RNA）（C对），是转录直接生成的RNA分子。生成的hnRNA需要经过5＇-端和3＇-端（首、尾部）的修饰以及对hnRNA进行剪接修饰，才能成为成熟的mRNA。rRNA（核糖体RNA）参与核糖核蛋白体的构成，核糖核蛋白体是蛋白质翻译的场所。tRNA（转运RNA）（B错）参与氨基酸的转运，合成肽链。snRNA（核内小RNA）（D错）参与真核细胞hnRNA的内含子加工剪接。核仁小RNA（snoRNA）（E错）定位于核仁，主要参与rRNA的加工和修饰。